通过阻断二磷酸腺苷P2Y₁₂受体，发挥抗血小板作用的药物是
A. 阿司匹林
B. 替罗非班
C. 西洛他唑
D. 双嘧达莫
E. 氯吡格雷

正确答案：E。氯吡格雷

解析：本题考查抗血小板药的药物分类。氯吡格雷（E对）属于二磷酸腺苷P2Y₁₂受体阻断剂。阿司匹林（A错）属于血栓素A₂抑制剂。替罗非班（B错）属于血小板糖蛋白Ⅱb/Ⅲa受体阻断剂。西洛他唑（C错）和双嘧达莫（D错）属于其他类抗血小板药。